下列关于五行生克规律的叙述，错的是
A. 木为水之子
B. 火为土之母
C. 水为火之所不胜
D. 金为木之所胜
E. 木为土之所不胜

正确答案：D。金为木之所胜

解析：五行的生克制化规律是五行结构系统在正常情况下的自动调节机制。生我者为母，我生者为子；克我者为所不胜，我克者为所胜。金克木，故金为木之所不胜（D错，为本题正确答案）。水生木，木为水之子（A对）。火生土，火为土之母（B对）。水克火，水为火之所不胜（C对）。木克土，木为土之所不胜（E对）。